我国体力劳动强度分级中计算劳动强度指数主要依据
A. 能量代谢和疲劳程度
B. 劳动时间率和心率
C. 肺通气量和心率
D. 能量代谢率和劳动时间率
E. 通气量和劳动时间率

正确答案：D。能量代谢率和劳动时间率